太阴之为病
A. 脉微细，但欲寐也
B. 消渴，气上撞心，心中疼热，饥而不欲食，食则吐蛔。下之利不止
C. 腹满而吐，食不下，自利益甚，时腹自痛
D. 口苦，咽干，目眩也
E. 胃家实是也

正确答案：C。腹满而吐，食不下，自利益甚，时腹自痛

解析：太阴病证可由寒湿之邪直接侵犯脾胃而成，亦可因三阳病治疗失当，损伤脾阳所致。脾阳虚弱，寒湿内生，气机阻滞，故腹满时痛；脾失健运则食纳减少；寒湿下注则下利；寒湿犯胃，胃失和降，故见呕吐；阳虚而失于温煦，故四肢欠温；脾阳虚弱，鼓动无力，故脉沉缓或弱（C对）。脉微细，但欲寐也（A错）为少阴病的提纲证。消渴，气上撞心，心中疼热，饥而不欲食，食则吐蛔，下之利不止（B错）为厥阴病的提纲证。口苦，咽干，目眩（D错）也为少阳病的提纲证。胃家实（E错）是也为阳明病的提纲证。